右锁骨下动脉
A. 起于主动脉弓
B. 起于头臂干
C. 于前斜角肌前方走行
D. 发出甲状腺上动脉
E. 该动脉的止血点是锁骨中点

正确答案：B。起于头臂干

解析：左锁骨下动脉起自主动脉弓（A错）。右锁骨下动脉起自头臂干（B对）。穿斜角肌间隙（C错）至第1肋外侧缘续为腋动脉。锁骨下动脉的主要分支有：椎动脉、胸廓内动脉、甲状颈干、肋颈干（D错）。该动脉的止血点是锁骨中点（E错）上方的锁骨上窝处。